盐酸苯海拉明属于
A. 氨基醚类组胺H₁受体拮抗剂
B. L-胺类组胺H₁受体拮抗剂
C. 哌嗪类组胺H₁受体拮抗剂
D. 丙胺类组胺H₁受体拮抗剂
E. 三环类组胺H₁受体拮抗剂

正确答案：A。氨基醚类组胺H₁受体拮抗剂